可引起失血性休克的是
A. 先兆流产
B. 不全流产
C. 稽留流产
D. 难免流产
E. 复发流产

正确答案：B。不全流产

解析：可引起失血性休克的是不全流产（B对），不全流产是难免流产继续发展，妊娠物部分残留于宫腔内或嵌顿于宫颈口处，影响子宫收缩，导致出血，甚至发生休克。先兆流产（A错）经休息及治疗后症状消失，可继续妊娠；若阴道流血增多或下腹痛加剧，可发展为难免流产。稽留流产（C错）指胚胎或胎儿已死亡滞留宫腔内未能及时自然排出者。难免流产（D错）指流产不可避免。复发流产（E错）指与同一性伴侣连续发生3次及3次以上的自然流产。